男性，40岁。自发牙痛2天。口含冰块可暂时缓解。叩诊（-），无松动，牙周检查（-）。可诊断为
A. 慢性根尖周炎急性发作
B. 急性牙髓炎化脓期
C. 急性牙龈脓肿
D. 深龋
E. 急性冠周炎

正确答案：B。急性牙髓炎化脓期

解析：本题考查急性牙髓炎的临床表现。男性，40岁。自发牙痛2天。口含冰块可暂时缓解。叩诊（-），无松动，牙周检查（-）。可诊断为急性牙髓炎化脓期（B对）。急性牙髓炎的疼痛性质具有自发性阵发性痛、温度刺激加剧疼痛等特点，若患牙正处于疼痛发作期，温度刺激可使疼痛加剧。如果牙髓已有化脓或部分坏死，即处于急性牙髓炎化脓期时，患牙可表现为所谓的热痛冷缓解，这可能是因为牙髓的病变产物中有气体出现，受热膨胀后使髓腔内压力进一步增高，产生剧痛，反之，冷空气或凉水可使空气气体体积收缩，减小压力而缓解疼痛，临床上常可见到患者携带凉水瓶就诊，随时含漱冷水进行止痛。患有深龋（D错）的牙对温度刺激也敏感，但往往是当冷热刺激进入深龋洞内才出现疼痛反应，不会出现口含冰块暂缓疼痛的现象。慢性根尖周炎急性发作（A错）时患者可有咬合疼痛，且患牙及其周围组织肿痛。急性牙龈脓肿（C错）的游离龈和龈乳头处可有红肿，在患牙的唇颊侧多有脓肿形成。急性冠周炎（E错）表现为患侧磨牙后区胀痛不适，炎症侵及咀嚼肌时可出现不同程度的张口受限。慢性根尖周炎急性发作、急性牙龈脓肿、急性冠周炎均没有热痛冷缓解的疼痛特点。